属于相畏的配伍是
A. 天南星配生姜
B. 甘草配甘遂
C. 石膏配牛膝
D. 丁香配郁金
E. 藜芦配白芍

正确答案：A。天南星配生姜

解析：相畏是一种中药的毒性或副作用能被另一种中药降低或消除，生姜可以抑制天南星的毒副作用（A对）。相反是两种中药同用能产生或增强毒性或副作用，如甘草反甘遂（B错）。相使是在性能功效方面有某些共性，其中以一种中药为主，另一种中药为辅，两药合用，辅药可以提高主药的功效，如石膏配牛膝治胃火牙痛，石膏为清胃降火、消肿止痛的主药，牛膝引火下行，可增强石膏清火止痛的作用（C错）。十九畏是指：…丁香畏郁金（D错）。“十八反歌诀”最早见于金·张子和《儒门事亲》：“本草明言十八反，半蒌贝蔹及攻乌，藻戟遂芫俱战草，诸参辛芍叛藜芦。”藜芦反白芍（E错）。